足月儿生理性黄疸正常的消退时间是
A. 生后2~3天
B. 生后4~6天
C. 生后10~14天
D. 生后15~18天
E. 生后20~25天

正确答案：C。生后10~14天

解析：该题考查生理性黄疸的特性。生理性黄疸足月儿在出生后10-14天消退（C对）。生理性黄疸，大部分新生儿在出生后第2-3天出现黄疸（A错），于4-6天最重（B错）。若出生后24小时内即出现黄疸，3周后仍不消退，甚或持续加深，或消退后复现，均为病理性黄疸（E错）。